终末消毒是在下列哪种情况下进行
A. 在传染源离开后对疫源地进行彻底消毒
B. 对各种公共场所消毒
C. 对水源、厕所、畜圈、厨房的消毒
D. 以上均不对

正确答案：A。在传染源离开后对疫源地进行彻底消毒

解析：本题考查终末消毒。终末消毒是当传染源痊愈、死亡或离开后对疫源地进行的彻底消毒（A对BCDE错），从而清除传染源所播散在外界环境中的病原体。